恶性黑色素瘤多来源于
A. 皮内痣
B. 交界痣
C. 复合痣
D. 毛痣
E. 雀斑

正确答案：B。交界痣

解析：本题考查恶性黑色素瘤的来源。突起于皮肤表面的交界痣容易受到摩擦与损伤的刺激，可能由此发生恶变，恶性黑色素瘤多来源于交界痣（B对）。根据组织病理学特点，色素痣可以分为交界痣、皮内痣和复合痣三种。皮内痣（A错）或复合痣（C错）包括毛痣（D错）、雀斑（E错），极少发生恶变，如有恶变亦来自复合痣中的交界痣成分。